关于基本医疗保险药品目录的说法，错误的是
A. 当前的目录全称是《国家基本医疗保险、工伤保险和生育保险药品目录》
B. 目录中的“甲类目录”和“乙类目录”由国家统制定，各地不得调整
C. 目录中的“甲类目录”的药品是临床必需，疗效好，同类药品中价格低的药品
D. 目录中的“乙类目录”的药品是可供临床治疗选择，疗效好，同类药品中略高的药品

正确答案：B。目录中的“甲类目录”和“乙类目录”由国家统制定，各地不得调整

解析：本题考查的是医保药品目录的分类、制定与调整。对于经国家有关部门批准上市的民族药品，可由各省级医疗保障部门牵头，会同人力资源社会保障部门根据当地的基金负担能力及用药需求，经相应的专家评审程序纳入本省（区、市）基金支付范围。各省调整民族药品的情况应报国家医保局备案后向社会公开（B错，为本题正确答案）。医保药品目录的分类、制定与调整：1.医保药品目录分类：医保药品目录分“甲类目录”和“乙类目录”。“甲类目录”的药品是临床治疗必需，使用广泛，疗效好，同类药品中价格低的药品（C对）。“乙类目录”的药品是可供临床治疗选择使用，疗效好，同类药品中比“甲类目录”药品价格略高的药品（D对）。医保目录调入分为常规准入和谈判准入两种方式。在满足有效性、安全性等前提下，价格（费用）与药品目录内现有品种相当或较低的，可以通过常规方式纳入目录；价格较高或对医保基金影响较大的专利独家药品应当通过谈判方式准入。《国家基本医疗保险、工伤保险和生育保险药品目录》列入品种为常规准入药品。目录共分为凡例、西药、中成药、协议期内谈判药品、中药饮片五部分。西药部分包括了化学药品和生物制品；中成药部分包含了中成药和民族药；协议期内谈判药品部分包括了尚处于谈判协议有效期内的药品。西药、中成药和协议期内谈判药品分甲乙类管理，协议期内谈判药品按照乙类支付。医保药品目录中列出了基本医疗保险、工伤保险和生育保险基金准予支付的中药饮片，同时列出了不得纳入基金支付的饮片范围。同时，目录包括限工伤保险基金准予支付费用的品种、限生育保险基金准予支付费用的品种。工伤保险和生育保险支付药品费用时不区分甲、乙类。2.医保药品目录制定与调整：国家医疗保障局负责制定医保药品目录准入谈判规则并组织实施。根据《2019年国家医保药品目录调整工作方案》，目录调整工作由国家医疗保障局牵头，会同工业和信息化部、财政部、人力资源社会保障部、国家卫生健康委、国家药品监督管理局、国家中医药管理局研究制定工作方案，研究确定目录调整的原则、程序，协调政策问题。目录调整分为准备、评审、发布常规准入目录、谈判、发布谈判准入目录5个阶段。根据《关于印发〈国家基本医疗保险、工伤保险和生育保险药品目录〉的通知》，各地不得自行制定目录或用变通的方法增加目录内药品，也不得自行调整目录内药品的限定支付范围。对于原省级药品目录内按规定调增的乙类药品，应在3年内逐步消化。消化过程中，各省应优先将纳入国家重点监控范围的药品调整出支付范围。对于经国家有关部门批准上市的民族药品，可由各省级医疗保障部门牵头，会同人力资源社会保障部门根据当地的基金负担能力及用药需求，经相应的专家评审程序纳入本省（区、市）基金支付范围。各省调整民族药品的情况应报国家医保局备案后向社会公开。医保药品目录中的中药饮片是从有国家标准的中药饮片中经专家评审产生的。对于其他有国家或地方标准的中药饮片，可由各省级医疗保障部门牵头，会同人力资源社会保障部门根据当地的基金负担能力及用药需求，经相应的专家评审程序纳入本省（区、市）基金支付范围，但不得增加目录中规定的不予支付的饮片。对于经省级药品监督管理部门批准的治疗性医院制剂，可由省级医疗保障部门牵头，会同人力资源社会保障部门根据当地的基金负担能力及用药需求，经相应的专家评审程序，制定纳入本省（区、市）基金支付范围的医院制剂目录，并按照有关规定限于特定医疗机构使用。《城镇职工基本医疗保险用药范围管理暂行办法》（劳社部〔1999〕15号）第2条规定：“基本医疗保险用药范围通过制定《基本医疗保险药品目录》进行管理。”以此为依据，2000年，我国正式制定了第一版《国家基本医疗保险药品目录》，2004年、2009年、2017年和2019年我国根据临床用药需求对目录作了调整。2019年4月17日，国家医疗保障局公布《2019年国家医保药品目录调整工作方案》，在此基础上组织开展目录调整工作，并于2019年8月20日发布《关于印发〈国家基本医疗保险、工伤保险和生育保险药品目录〉的通知》（医保发〔2019〕46号），公布了2019年版《国家基本医疗保险、工伤保险和生育保险药品目录》（A对）。